属于糖皮质激素禁忌证的是
A. 严重高血压
B. 过敏性皮炎
C. 再生障碍性贫血
D. 类风湿性关节炎
E. 血管神经性水肿

正确答案：A。严重高血压

解析：本题考查糖皮质激素的禁忌症。属于糖皮质激素禁忌证的是严重高血压（A对）。糖皮质激素的禁忌证：①严重精神病或癫痫病史者、活动性消化性溃疡病或新近胃肠吻合术者、骨折患者、创伤修复期患者、角膜溃疡者、肾上腺皮质功能亢进者、严重高血压、糖尿病患者。②妊娠早期妇女。③抗菌药物不能控制的水痘、真菌感染者。④未能控制的结核、细菌和病毒感染者。过敏性皮炎（B错）、再生障碍性贫血（C错）、类风湿性关节炎（D错）、血管神经性水肿（E错）均为糖皮质激素的适应证。